低蛋白血症引起水肿的机制是
A. 毛细血管内压升高
B. 血浆胶体渗透压下降
C. 组织间液的胶体渗透压升高
D. 组织间液的流体静压下降
E. 毛细血管壁通透性升高

正确答案：B。血浆胶体渗透压下降

解析：低蛋白血症是指各种原因导致的血浆蛋白质含量降低。血浆蛋白质含量降低可直接引起血浆胶体渗透压下降（B对），血浆内液体向组织内转移，组织液生成增加，当超过淋巴代偿能力时，可发生水肿。低蛋白血症对毛细血管内压（A错）、组织间液的胶体渗透压（C错）、组织间液的流体静压（D错）和毛细血管壁通透性（E错）无明显影响。